不属于骨盆底外层范畴肌肉是
A. 球状海绵体肌
B. 坐骨海绵体肌
C. 会阴浅横肌
D. 肛门外括约肌
E. 会阴深横肌

正确答案：E。会阴深横肌

解析：骨盆底由外向内分为三层，外层范畴肌肉包括球海绵体肌（A对）、坐骨海绵体肌（B对）、会阴浅横肌（C对）、肛门外括约肌（D对）。中层范畴肌肉包括会阴深横肌（E错，为本题正确答案）。内层为盆膈，由肛提肌及其内、外筋膜组成。